中央前回位于
A. 中央前沟的前方
B. 中央后沟的前方
C. 外侧沟的前方
D. 中央沟与外侧沟之间
E. 中央沟和中央前沟之间

正确答案：E。中央沟和中央前沟之间

解析：中央前回位于中央沟和中央前沟之间（E对）。